女，30岁，近半年来感到左上后牙轻度松动，咬合不适，无明显疼痛，检查：牙咬合面磨耗不均匀，左上6松动I度，牙周袋探诊深度3mm，探及少许龈下牙石，X-ray示：牙：牙周膜影像增宽，未见牙槽骨吸收。以下牙松动的最可能原因是
A. 慢性牙周炎
B. 外伤
C. 慢性龈炎
D. （牙合）创伤
E. 牙周韧带的急性炎症

正确答案：D。（牙合）创伤

解析：本题考查牙松动的原因。患者牙齿咬合面磨耗不均，松动，咬合不适，无明显疼痛，牙周膜影像增宽却未见牙槽骨吸收，根据以上临床表现可判定引起患牙松动的原因是（牙合）创伤（D对），有咬合创伤时可使牙槽骨发生垂直吸收，牙周膜间隙呈楔形增宽，硬骨板消失，牙齿松动，但单纯的创伤不会引起牙周袋的形成。慢性牙周炎（A错）可有牙周袋形成，同时伴有牙槽骨水平型或垂直型吸收。外伤（B错）引起的牙松动常伴有明显疼痛感。慢性龈炎（C错）的龈沟探诊深度可达3mm以上，且一般不引起牙松动。牙周韧带的急性炎症（E错）如急性根尖周炎或牙周脓肿等由于牙周膜充血水肿及渗出可使牙明显松动，患者多伴有明显的疼痛。